咽-结合膜热的病原体为
A. 流感病毒
B. 合胞病毒
C. 柯萨奇病毒
D. 腺病毒
E. EB病毒

正确答案：D。腺病毒

解析：咽-结合膜热的病原体为腺病毒（D对），血清型为3、7、14，常发生于春夏季，散发或发生小流行。以发热、咽炎、结膜炎为特征，症状与急性发热性咽喉炎相似，但常同时发生结膜炎，有暴发流行倾向。流感病毒（A错）常引起流感。合胞病毒（B错）是引起小儿病毒性肺炎最常见的病原，可引起间质性肺炎，及毛细支气管炎。柯萨奇病毒（C错）可引起疱疹性咽峡炎和非麻痹性类脊髓灰质炎。EB病毒（E错）可引起传染性单核细胞增多症、非洲儿童淋巴瘤（即Burkitt淋巴瘤）、鼻咽癌。